无菌操作原则中，错误的是
A. 手术者的上肢前臂一旦触及有菌物后，应更换手套
B. 发现手套有破口时，应立即更换
C. 无菌手术单湿透时，应加盖干无菌单
D. 禁止越过头部或从术者背后传递无菌器械物品
E. 坠落在手术台边缘以下的器械物品，不准拾回再用

正确答案：A。手术者的上肢前臂一旦触及有菌物后，应更换手套